颊长神经阻滞麻醉一般注射麻药量是
A. 0.1ml
B. 0.5～1ml
C. 1.5～2ml
D. 2.5ml
E. 2～3ml

正确答案：B。0.5～1ml

解析：本题考查颌面部常用局麻法及牙拔除的麻醉选择。由于行下牙槽神经麻醉的针刺点在翼下颌韧带中点外侧2～3mm处，此进针点周围正是颊神经分布的区域并接近颊神经干，所以可在下牙槽神经阻滞麻醉过程中，针尖退至肌层、黏膜下时注射麻醉药0.5～1ml（B对），即能麻醉颊神经。